通过梨状肌下孔出骨盆的神经，没有
A. 阴部神经
B. 臀下神经
C. 坐骨神经
D. 臀上神经
E. 股后皮神经

正确答案：D。臀上神经

解析：通过梨状肌下孔出骨盆的神经包括阴部神经（A错）、臀下神经（B错）、坐骨神经（C错）、股后皮神经（E错）。臀上神经（D对）通过梨状肌上孔出骨盆。